为碳酸盐类矿物质方解石族菱锌矿，主含ZnCO₃矿物药的是
A. 朱砂
B. 雄黄
C. 赭石
D. 自然铜
E. 炉甘石

正确答案：E。炉甘石

解析：本题考查的是炉甘石的来源。为碳酸盐类矿物质方解石族菱锌矿，主含ZnCO₃矿物药的是炉甘石（E对）。炉甘石：【来源】为碳酸盐类矿物方解石族菱锌矿。主含碳酸锌（ZnCO₃）。朱砂（A错）：【来源】为硫化物类矿物辰砂族辰砂。主含硫化汞（HgS）。雄黄（B错）：【来源】为硫化物类矿物雄黄族雄黄。主含二硫化二砷（As₂S₂）。赭石（C错）：【来源】为氧化物类矿物刚玉族赤铁矿。主含三氧化二铁（Fe₂O₃）。自然铜（D错）：【来源】为硫化物类矿物黄铁矿族黄铁矿。主含二硫化铁（FeS₂）。